牙周袋的临床表现与组织病理改变的关系，错误的为
A. 局部血循环阻滞→牙龈呈暗红色
B. 牙龈表面上皮增生→牙龈表面光亮、点彩消失
C. 袋壁溃疡→探诊痛
D. 袋壁溃疡→探诊后出血
E. 袋外侧壁的纤维性增生→质地致密

正确答案：B。牙龈表面上皮增生→牙龈表面光亮、点彩消失

解析：本题考查牙周袋的临床表现与组织病理改变的关系。牙周袋是病理性加深的龈沟，是牙周炎最重要的病理改变之一。正常牙龈呈粉红色，表面柔软光滑，牙龈表面上皮增生会出现牙龈肿大、质地坚韧等，而牙龈表面光亮、点彩消失是由牙龈表面上皮萎缩，组织水肿所致（B错，为本题的正确答案）。牙龈的局部血循环阻滞会导致牙龈呈暗红色（A对）。牙周袋袋壁常有溃疡，溃疡会导致探诊后出血（D对）及探诊痛（C对），袋的外侧壁纤维性增生会导致牙周袋质地致密（E对）。